颈外侧深淋巴结
A. 大部沿颈内静脉排列
B. 大部沿颈外静脉排列
C. 大部沿锁骨下动脉排列
D. 输出管合成颈干和支气管纵隔干
E. 以上都不正确

正确答案：A。大部沿颈内静脉排列

解析：颈外侧深淋巴结大部分沿颈内静脉排列（A对），颈外侧浅淋巴结主要沿颈外静脉排列（B错）。